致癌试验属于
A. 毒理学评价第一阶段
B. 毒理学评价第二阶段
C. 毒理学评价第三阶段
D. 毒理学评价第四阶段
E. 危险度评价

正确答案：D。毒理学评价第四阶段

解析：本题考查毒理学安全性评价阶段。毒理学安全性评价阶段为：第一阶段：急性毒性试验和局部毒性评价；第二阶段：遗传毒理学试验和致畸试验；第三阶段：亚慢性毒性试验、繁殖试验和代谢试验；第四阶段（D对ABCE错）：慢性毒性试验和致癌试验。